女，67岁，车祸后即昏迷，伤后2小时被送至医院。查体：昏迷状态，左顶枕部有一直径4cm头皮血肿，右侧瞳孔散大，对光反射消失，左侧肢体肌张力增高，病理反射阳性。头颅CT示右额颞部骨板下新月形高密度影。该患者颅内出血最可能来自于
A. 脑表面小血管
B. 硬脑膜中动脉
C. 大脑中动脉
D. 蛛网膜颗粒
E. 矢状窦

正确答案：A。脑表面小血管

解析：老年女性患者，车祸后持续昏迷，左顶枕部有一头皮血肿（提示右额颞部对冲伤），右侧瞳孔散大，对光反射消失（提示右侧动眼神经受压），左侧肢体肌张力增高，病理反射阳性（提示右侧小脑幕切迹疝），头颅CT示右额颞部骨板下新月形高密度影（急性硬膜下血肿的典型影像学表现），结合患者病史、临床表现和影像学检查，最可能的诊断为右额颞急性硬脑膜下血肿并小脑幕切迹疝。硬脑膜下血肿主要是由于对冲性脑挫裂伤引起脑表面小血管（A对）破裂而形成的。脑膜中动脉（B错）是硬膜外血肿的主要出血来源。大脑中动脉（C错）的分支—豆纹动脉是高血压脑出血的常见出血来源。蛛网膜颗粒（D错）指脑蛛网膜突入上矢状窦内形成的绒毛状突起，是脑脊液回流入静脉的重要部位，较少受到损伤。矢状窦（E错）是脑内静脉血液回流的重要通道，其破裂出血可引起硬膜外血肿。